碘量法使用的指示剂是
A. 结晶紫
B. 酚酞
C. 淀粉
D. 邻二氮菲
E. 甲基红

正确答案：C。淀粉

解析：本题考查碘量法。淀粉（C对）是碘量法的指示剂。结晶紫（A错）是非水滴定法中非水碱量法的指示剂。酚酞（B错）、甲基红（E错）均为酸碱滴定法的指示剂。邻二氮菲（D错）是铈量法的指示剂。